治疗高血压伴心力衰竭，应首选的药物是
A. α受体阻断药
B. β受体阻断药
C. 钙通道拮抗剂
D. 利尿剂
E. 血管紧张素转化酶抑制药

正确答案：E。血管紧张素转化酶抑制药

解析：血管紧张素转化酶抑制可以减轻心脏前后负荷，具有降压作用，可以延缓和逆转心室重构，阻止心肌肥厚的进一步发展，改善血管内皮功能和心功能，减少心律失常的发生，还能提高生存率，改善预后。对伴有心力衰竭、左心室肥大、心肌梗死后、房颤、蛋白尿或微量白蛋白尿、慢性肾脏疾病、代谢综合征、糖耐量降低及糖尿病肾病等合并症尤为适宜。所以治疗高血压伴心力衰竭首选血管紧张素转化酶抑制药（E对）。α受体阻断药一般不作为高血压的首选药。适用于高血压伴前列腺增生等患者，也用于难治性高血压患者的治疗（A错）。β受体阻断药适用于1、2级高血压患者，尤其是心律较快的中青年患者，或合并心绞痛、心肌梗死、慢性心力衰竭、交感神经活性增高及高动力状态的高血压患者（B错）。钙通道拮抗剂可用于中、重度高血压的治疗，适宜于单纯性收缩压增高的老年病患者（C错）。利尿剂用于轻、中度高血压，适用于老年高血压、单纯收缩期高血压、难治性高血压、心力衰竭合并高血压的治疗（D错）。